甲类传染病是指
A. SRS，狂犬病
B. 黑热病，炭疽
C. 高致病性禽流感，天花
D. 鼠疫，霍乱
E. 伤寒，流行性出血热

正确答案：D。鼠疫，霍乱

解析：甲类传染病有两个：①鼠疫；②霍乱（D对）。SARS、狂犬病（A错）、炭疽（B错）、高致病性禽流感（C错）、流行性出血热（E错）属于乙类传染病，城镇6小时内上报，农村12小时内上报。黑热病（B错）属于丙类传染病发现后24小时内上报。需注意，乙类传染病中传染性非典型肺炎，炭疽中的肺炭疽，人感染高致病性禽流感，和脊髓灰质炎必须按甲类传染病采取报告控制措施。